患者，男，42岁。患菌痢已1年余，时发时止，乏力纳呆，嗜卧怕冷，大便粘液夹有血液，舌淡苔腻，脉虚而数。痢疾发作时，粪便镜检30～40个白细胞/高倍视野。其证型是
A. 休息痢
B. 寒湿痢
C. 湿热痢
D. 阴虚痢
E. 虚寒痢

正确答案：A。休息痢

解析：下痢日久，正虚邪恋，寒热夹杂，肠道传导失司故缠绵难愈，时发时止；脾胃虚弱，中阳健运失司故乏力纳呆，嗜卧怕冷；湿热留恋不去，感受外邪或饮食不当诱发大便粘液夹有血液；舌淡苔腻，脉虚而数，均为休息痢的特点（A对）。寒湿痢（B错）的特点为下痢赤白粘冻，白多赤少，伴腹痛，里急后重，脘腹饱胀，头身困重，舌淡苔白腻，脉濡缓。湿热痢（C错）的特点为下痢赤白黏冻，赤多白少，里急后重，肛门灼热，腹痛灼热。阴虚痢（D错）的特点为少量脓血便，腹痛隐隐，午后发热，盗汗，五心烦热，头晕眼花，神疲懒言。虚寒痢（E错）的特点为迁延日久，腹痛喜温喜按，腹胀，腰膝酸软，食少，形寒肢冷，神疲懒言。